患者，男，27岁。颈项部皮肤增厚，瘙痒反复发作1年余，局部皮肤呈苔藓化。其诊断是
A. 风热疮
B. 风瘙痒
C. 牛皮癣
D. 白屑风
E. 慢性湿疮

正确答案：C。牛皮癣

解析：风热疮有母斑的存在，然后继发子斑，皮疹淡红色，皮损长轴沿肋骨方向排列，瘙痒剧烈，有自限性，无藓化，无皮肤增厚（A错）。风瘙痒无原发性皮损，主要表现为阵发性瘙痒，尤以夜间为重，皮损为骚抓引起（B错）。牛皮癣是一种皮肤状如牛项之皮，厚且坚的慢性瘙痒性皮肤病，多发于青壮年，多发于颈部、额部，皮损初起有聚集倾向的扁平丘疹，干燥而结实，久之融合成片，逐渐扩大，皮肤增厚干燥成席纹状，自觉阵发性奇痒，局限性皮损仅见于颈项等局部，为少数境界清楚的苔藓样肥厚斑片，题中患者颈部皮肤增厚，瘙痒反复，局部皮肤呈苔藓化，符合牛皮癣的诊断（C对）。白屑风即面游风，是因皮肤油腻而出现红斑、覆有鳞屑而得名，发生于皮脂丰富部位，干性者，皮损上有片状白色鳞屑，在头皮部可堆叠很厚，湿性者，皮损红斑、糜烂、流滋，有油腻性痂屑（D错）。慢性湿疮皮损也可藓化，但仍有丘疹、小水疱，点状糜烂，流滋，病变多在四肢屈侧（E错）。